槐花除凉血止血外，又能
A. 祛痰止咳
B. 清肝泻火
C. 解毒杀虫
D. 活血散瘀
E. 清热安胎

正确答案：B。清肝泻火